瞳孔对光反射
A. 一侧视束损伤，光照健侧眼，患侧瞳孔不缩小
B. 一侧视神经损伤，光照健侧眼引起双眼瞳孔缩小
C. 一侧动眼神经损伤，光照健侧眼，两侧瞳孔都不缩小
D. 顶盖前区是瞳孔对光反射的唯一中枢
E. 无

正确答案：B。一侧视神经损伤，光照健侧眼引起双眼瞳孔缩小

解析：一侧视神经受损时，信息传入中断，光照患侧眼的瞳孔，两侧瞳孔均不反应；但光照健侧眼的瞳孔，则两眼对光反射均存在，即双眼瞳孔缩小（B对），一侧动眼神经受损时，由于信息传出中断，无论光照哪一侧眼，患侧眼的瞳孔对 光反射都消失（C错）， 顶盖前区发出纤维到中脑动眼神经副核，构成瞳孔对光反射通路的一部分（D错），一侧视束损伤，光照健侧眼，患侧瞳孔缩小（A错）。